关于芒硝的使用方法，叙述错误的是
A. 外用：点眼
B. 外用：喷撒
C. 内服：包煎
D. 内服：开水溶化
E. 内服：冲入药汁内

正确答案：C。内服：包煎

解析：本题考查的是芒硝的用法用量。关于芒硝的使用方法，叙述错误的是内服：包煎（C错，为本题正确答案）。芒硝：【用法用量】内服：汤剂，10～15g，冲入药汁内（E对）或开水溶化（D对）；或入丸散。外用：适量，喷撒（B对），漱口，点眼（A对），化水坐浴。